下列关于医学参考值范围的叙述，不正确的是
A. 无疾病者的解剖、生理、生化等数据的波动范围
B. 习惯以包含95％或99％的观察值为界值
C. 根据专业知识确定单侧范围或双侧范围
D. 资料为正态分布时，可用正态分布法计算
E. 资料为偏态分布时，可用百分位数法计算

正确答案：A。无疾病者的解剖、生理、生化等数据的波动范围

解析：本题考查医学参考值的相关内容。医学参考值是指特定的“正常”人群（排除了对所研究指标有影响的疾病和有关因素的特定人群）的解剖、生理、生化指标及组织代谢产物含量等数据中大多数个体的取值所在的范围（A对BCDE错）。人们习惯用该人群中95%的个体某项医学指标的取值范围作为该指标的医学参考值范围。